初产妇，孕37周，清晨骤醒发现躺在血中，急诊入院，查血压12/8kPa（90/60mmHg），脉搏120次/分，神清，胎心音160次/分，阴道少量活动性流血此时所需的检查不应包括哪一项
A. 血红蛋白+出凝血时间
B. 配血
C. OCT（催产素激惹试验）
D. B超
E. 普鲁卡因皮试

正确答案：C。OCT（催产素激惹试验）

解析：OCT（催产素激惹试验）在产前不明原因出血时属于禁忌的，有胎盘机能低下者可以用。掌握“前置胎盘”知识点。